男性，68岁，口腔溃烂3个月来诊，体检发现双颊黏膜大面积糜烂，有边缘扩展现象，糜烂面表面被覆较厚的灰白伪膜，呈斑片状。经脱落细胞学检查拟诊为天疱疮。查血常规及分类白细胞1.6×10⁹/L，中性粒细胞占82%。本病例最切合实际的首选治疗为
A. 1％～2％普鲁卡因液含漱止痛
B. 局部应用皮质类固醇激素类软膏
C. 全身给予抗生素，口腔局部用0．25％金霉素含漱液
D. 口含制霉菌素，口腔局部用碱性漱口水
E. 保持口腔卫生，去除刺激因素

正确答案：C。全身给予抗生素，口腔局部用0．25％金霉素含漱液

解析：本题考查天疱疮的疾病管理。该患者白细胞1.6×10⁹/L，中性粒细胞占82%，提示口腔感染明显，全身给予抗生素，口腔局部用0．25%金霉素（四环素类）含漱液（C对）是最切合实际的首选治疗，控制感染，消除炎症，利于疾病恢复。1％～2％普鲁卡因液含漱止痛（A错）是在疼痛影响进食，在进食之前采用的措施。糖皮质激素是治疗天疱疮的首选药物，但这是个长期的过程，因此局部应用皮质类固醇激素类软膏（B错）不能解决目前最重要的感染问题，不是最切合实际的治疗。口含制霉菌素，口腔局部用碱性漱口水（D错）是治疗口腔念珠菌感染的方法。保持口腔卫生，去除刺激因素（E错）主要是为了减少口腔继发感染，也不是首选治疗。